应用于下颌牙槽嵴狭窄病例的固定义齿桥体是
A. 船底式桥体
B. 悬空式桥体
C. 改良鞍式桥体
D. 盖嵴式桥体
E. 改良盖嵴式桥体

正确答案：A。船底式桥体

解析：本题考查桥体的形态设计。应用于下颌牙槽嵴狭窄病例的固定义齿桥体是船底式桥体（A对）。1.船底式桥体用于下颌牙槽嵴狭窄的病例。2.悬空式桥体（B错）又称为卫生桥，它与天然牙的形态差异大，美观性差，舌感不舒服，主要用于失牙区牙槽嵴缺损较大的后牙缺失修复。3.改良鞍式桥体（C错）接近天然牙冠外形，美观、舒适、自洁作用好，是一种理想的桥体形式，也是临床采用较多的一种桥体形式。4.盖嵴式桥体（D错）又称偏侧型桥体，主要用于上颌前牙牙槽嵴吸收较多者。5.改良盖嵴式桥体（E错）又称为牙槽嵴顶型桥体或者改良偏侧型桥体，其特点是可以防止食物进人龈端，自洁作用好，患者感觉舒适，上、下颌固定桥都可以使用该设计。